下列特定穴中，多用于治疗脏腑疾病的是
A. 原穴
B. 络穴
C. 八脉交会穴
D. 八会穴
E. 荥穴

正确答案：A。原穴

解析：原穴与三焦关系密切，“三焦为原气之别使”《难经·六十六难》，三焦之气源于肾间动气，输布全身，调和内外，宣导上下，关系者脏腑气化功能，而原穴正是其所流注的部位。又《灵枢·九针十二原》指出：“五脏六腑之有病者，取其原也”，因此，原穴（A对）主要用于治疗相关脏腑的疾病；络穴（B错）可治疗其络脉的病证，又可治疗表里两经的病证；八脉交会穴（C错）具有治疗奇经八脉相应的病证；八会穴（D错）虽属于不同经脉，但对于各自所会的脏、腑、气、血、筋、脉、骨、髓相关的病证有特殊的治疗作用，临床上常把其作为治疗这些病证的主要穴位；荥穴（E错）主要治疗相应经脉的热证。